下列产品中，属于第三类医疗器械的是
A. 创可贴
B. 医用脱脂棉
C. 一次性无菌注射器
D. 口罩
E. 血压计

正确答案：C。一次性无菌注射器

解析：本题考查医疗器械的分类。第三类是具有较高风险，需要采取特别措施严格控制管理以保证其安全、有效的医疗器械。如心脏起搏器、体外反搏装置、血管内窥镜、超声肿瘤聚焦刀、高频电刀、微波手术刀、医用磁共振成像设备、钴60治疗机、正电子发射断层扫描装置（PECT）、植入器材、植入式人工器官、血管支架、血管内导管、一次性使用无菌注射器（C对）、一次性使用输液器、输血器等。创可贴（A错）属于第一类医疗器械。医用脱脂棉（B错）、口罩（D错）和血压计（E错）属于第二类医疗器械。